自我药疗时，解热镇痛药用于解热，连续用药时间不宜超过
A. 1日
B. 3日
C. 5日
D. 7日
E. 10日

正确答案：B。3日

解析：本题考查解热镇痛药的使用。自我药疗时，解热镇痛药用于解热，连续用药时间不宜超过3日（B对）。解热镇痛药用于退热一般不超过3天，如症状未缓解应及时就医，不得自行长期服用。用于疼痛时一般不超过5天（C错），如症状未缓解，可能是用药不对症或者病症比较严重，应去医院就诊，对症治疗。